甲型强心苷元的C-17位侧链是
A. 共轭双键
B. α，β-不饱和酮
C. α，β-不饱和酸
D. α，β-不饱和五元内酯环
E. 共轭叁键

正确答案：D。α，β-不饱和五元内酯环

解析：本题考查的是甲型强心苷元的特征。根甲型强心苷元的C-17位侧链是α，β-不饱和五元内酯环（D对）。强心苷是存在于生物界中的一类对心脏有显著生理活性的甾体苷类。主要分布于夹竹桃科、玄参科、百合科、萝藦科、十字花科、毛茛科和桑科等。动物中至今尚未发现强心苷成分，中药蟾酥是一类具有强心作用的甾体化合物，但不属于苷类，属于蟾毒配基的脂肪酸酯类。根据C-17侧链不饱和内酯环的不同，将强心苷元分为两类。①甲型强心苷元（强心甾烯类）：甾体母核的C-17侧链为五元不饱和内酯环（Δαβ-γ-内酯），基本母核称为强心甾，由23个碳原子构成。在已知的强心苷元中，大多属于此类。②乙型强心苷元（海葱甾二烯或蟾蜍甾二烯类）：甾体母核的C-17侧链为六元不饱和内酯环（Δαβ，γδ-δ-内酯），基本母核为海葱甾或蟾蜍甾。自然界中仅少数苷元属此类，如中药蟾蜍中的强心成分蟾毒配基类。